关于骨软骨瘤临床表现的叙述，正确的是
A. —般无症状，生长缓慢的骨性突起
B. 肿物与周围界限不清
C. X线检査可见骨膜反应
D. 肿块明显，皮肤有静脉怒张
E. 生长较快，伴明显疼痛

正确答案：A。—般无症状，生长缓慢的骨性突起

解析：骨软骨瘤是一种常见的、软骨源性的良性肿瘤，是位于骨表面的骨性突起物，生长缓慢，一般无症状，多见于长骨干骺端（A对）。肿物与周围界限不清（B错）、骨膜反应（C错）、皮肤有静脉怒张（D错）、生长较快伴明显疼痛（E错）均为恶性骨肿瘤的临床表现。